长期使用阿片类药物，导致机体对其产生适应状态，停药出现戒断综合征，这种药物的不良反应称为
A. 精神依赖性
B. 药物耐受性
C. 身体依赖性
D. 反跳反应
E. 交叉耐药性

正确答案：C。身体依赖性

解析：本题考查药物依赖性。长期使用阿片类药物，导致机体对其产生适应状态，停药出现戒断综合征，这种药物的不良反应称为身体依赖性（C对）。躯体依赖性是指中枢神经系统对长期使用的药物所产生的一种身体适应状态；一旦停药，将发生一系列生理功能紊乱，称为戒断综合征。可以产生身体依赖性的药物有阿片类（如阿片、吗啡、海洛因等）、镇静催眠药（巴比妥类、苯二氮䓬类）和酒精等。精神依赖性（A错）是指多次用药后使人产生欣快感，导致用药者在精神上对所用药物有一种渴求连续不断使用的强烈欲望，继而引发强迫用药行为，以获得满足和避免不适感，也称为成瘾性。药物耐受性（B错）是指在连续用药过程中，有的药物的药效会逐渐减弱，需加大剂量才能显效的现象。反跳反应（D错）又称停药反应，是指患者长期应用某种药物，突然停药后出现原有疾病加剧的现象。交叉耐药性（E错）是指病原体对某种药物耐药后，对于结构近似或作用性质相同的药物也可显示耐药性的现象。